肠管无生机的根据哪项不对
A. 肠管无弹性及张力
B. 相应的肠系膜终末小动脉无搏动
C. 肠管的颜色变黑
D. 肠管对刺激有反应，能收缩
E. 肠管无蠕动能力

正确答案：D。肠管对刺激有反应，能收缩

解析：绞窄性肠梗阻由于肠段有血运障碍，易发生肠坏死，因此需及时手术治疗。手术时应根据肠袢有无生机，考虑是否作肠切除。肠管对刺激有反应，能收缩提示肠管尚有生机（D错，为本题正确答案），可不行肠切除。肠管无弹性及张力（A对）、相应的肠系膜终末小动脉无搏动（B对）、肠管的颜色变黑（C对）、无蠕动能力（E对）等均提示肠管已无生机，需要切除坏死肠袢。一看:观察颜色 二摸:有无搏动，收缩 三注射:注射温生理盐水，和普鲁卡因 有下列表现的则表明肠管已无生机：①肠壁已成紫黑色并已塌陷； ②肠壁已失去张力和蠕动能力，对刺激无收缩反应； ③相应的肠系膜终末小动脉无搏动（P376）。